通过哪种方式可以减少金属镉向农作物转移
A. 加入其他有机物，使其产生拮抗作用
B. 加入石灰调节土壤pH，使镉成难溶的盐，减少转移
C. 使土壤中氧气充分，创造氧化条件
D. 加入硅酸使土壤pH降低，转化成难溶盐
E. 以上都不是

正确答案：B。加入石灰调节土壤pH，使镉成难溶的盐，减少转移

解析：本题考查减少金属镉向农作物转移的方式。当土壤pH偏碱性时，多数金属离子形成难溶的氢氧化物而沉淀，植物难以吸收。因此，加入石灰调节土壤pH，使镉成难溶的盐，可减少金属镉向农作物转移（B对ACDE错）。